《中国药典》规定，气雾剂稳定加速试验时间
A. 温度30±5℃，湿度65±5%,时间12个月
B. 温度30±5℃，湿度65±5%，时间9个月
C. 温度30±5℃，湿度65±5%，时间6个月
D. 温度30±5℃，湿度65±5%,时间3个月
E. 温度30±5℃，湿度65±5%,时间1个月

正确答案：C。温度30±5℃，湿度65±5%，时间6个月

解析：本题考查中药制剂稳定性考察方法的加速试验。《中国药典》规定，气雾剂稳定加速试验时间为温度30±5℃，湿度65±5%，时间6个月（C对）。常规试验法：取市售包装的制剂3批，在温度40℃±2℃、相对湿度75%±5%的条件下放置6个月。在试验期间第1个月、2个月、3个月、6个月末分别取样一次，按照稳定性重点考察项目检测。在上述条件下，如6个月供试品经检测不符合质量标准相关规定，则应在中间条件（30℃±2℃、相对湿度65%±5%）下进行加速试验，时间仍为6个月。溶液剂、注射剂等含有水性介质的制剂可不要求相对湿度，其他条件同上。对温度特别敏感的药物制剂，预计只能在冰箱（4℃-8℃）内保存使用，此类制剂可在温度25℃±2℃、相对湿度60%±10%的条件下进行，时间为6个月。乳剂、混悬剂、软膏剂、乳膏剂、糊剂、凝胶剂、眼膏剂、栓剂、气雾剂、泡腾片剂及泡腾颗粒宜直接采用温度30℃±2℃、相对湿度65%±5%的条件试验，其他要求与上述相同。对于包装在半透明容器中的制剂，如低密度聚乙烯制备的输液袋、塑料安瓿、眼用制剂容器等，则应在温度40℃±2℃、相对湿度25%±5%的条件下进行试验。